某男，48岁，突患急性支气管炎，症见身热口渴，咳嗽痰盛，喘促气逆，胸膈满闷，医师诊断为表寒里热之咳喘。又用药7天，口干咽痛、大便干燥、痰黄粘稠症虽已，当仍咳嗽痰多、胸闷气急，其证转为痰气阻肺，治当化痰止咳、宽中下气，此时宜选用的成药是
A. 急支糖浆
B. 通宣理肺丸
C. 强力枇杷露
D. 橘贝半夏颗粒
E. 蜜炼川贝枇杷膏

正确答案：D。橘贝半夏颗粒

解析：本题考查的是橘贝半夏颗粒的功能与主治。口干咽痛、大便干燥、痰黄粘稠症虽已，当仍咳嗽痰多、胸闷气急，其证转为痰气阻肺，治当化痰止咳、宽中下气，此时宜选用的成药是橘贝半夏颗粒（D对）。橘贝半夏颗粒：【功能】化痰止咳，宽中下气。【主治】痰气阻肺，咳嗽痰多、胸闷气急。急支糖浆（A错）：【功能】清热化痰，宣肺止咳。【主治】外感风热所致的咳嗽，症见发热、恶寒、胸膈满闷、咳嗽咽痛；急性支气管炎、慢性支气管炎急性发作见上述证候者。通宣理肺丸（B错）：【功能】解表散寒，宣肺止咳。【主治】风寒束表、肺气不宣所致的感冒咳嗽，症见发热、恶寒、咳嗽、鼻塞流涕、头痛、无汗、肢体酸痛。强力枇杷露（C错）：【功能】清热化痰，敛肺止咳。【主治】痰热伤肺所致的咳嗽经久不愈、痰少而黄或干咳无痰；急、慢性支气管炎见上述证候者。蜜炼川贝枇杷膏（E错）：【功能】清热润肺，化痰止咳。【主治】肺燥咳嗽，痰黄而黏，胸闷，咽喉疼痛或痒，声音嘶哑。